女，21岁。因工作紧张，近一个月感觉压力重重，不能胜任工作，觉的自己一无是处，连累了父母，开煤气自杀被急送入院。入院后又趁人不备打破窗玻璃，用碎玻璃自杀，后经抢救脱险。经检查患者有青光眼病史。为尽快消除患者自杀念头，首选治疗是
A. 心理疏导
B. 暗示治疗
C. 新型抗抑郁药
D. 电抽搐治疗
E. 睡眠剥夺治疗

正确答案：D。电抽搐治疗

解析：该病患近一个月（病程持续时间大于2周）觉得自己一无是处（自我评价低，无价值感），连累了父母（自罪观念），开煤气自杀，入院后又趁人不备用碎玻璃自杀（自杀观念和行为），最可能的诊断为抑郁症。该患者开煤气自杀被急送入院，入院后又趁人不备打破窗玻璃，用碎玻璃自杀（严重自杀倾向），应首选电抽搐治疗（D对）。暗示治疗多见于分离（转换）性障碍（B错）。但本题中患者有青光眼病史，为电抽搐治疗的禁忌症（P244），本题原答案为D，考虑到患者病史，答案有争议。